造成宫颈黏液涂片干后镜下见羊齿状结晶的激素是
A. 雌激素
B. 孕激素
C. 雄激素
D. 催乳激素
E. 甲状腺素

正确答案：A。雌激素

解析：宫颈黏液中的蛋白质、糖和某些电解质相结合，于涂片干燥后出现羊齿状结晶，雌激素（A对）促进结晶形成，孕激素（B错）则抑制其形成。排卵前受雌激素的影响，宫颈黏液分泌量逐渐增多，黏液分泌稀薄而透明，月经周期第7天出现不典型结晶，排卵期出现典型羊齿状结晶。排卵后受孕激素影响，黏液分泌量逐渐减少，质地变黏稠而浑浊，涂片检查时结晶逐步模糊，至月经周期第22日左右完全消失，而代之以排列成行的椭圆体。